叩诊的注意事项之一是
A. 先叩正常牙，后叩患病牙齿
B. 用器械的尖头工作端做叩诊
C. 力量按从大到小的顺序进行
D. 方向和牙长轴垂直查根尖部
E. 方向与牙长轴一致查根周部

正确答案：A。先叩正常牙，后叩患病牙齿

解析：本题考查叩诊的注意事项。叩诊的注意事项之一是先叩正常牙，后叩患病牙齿（A对）。叩诊是用平头金属器械的末端（B错）叩击牙齿，根据患者的反应和叩击声音确定患牙的方法，是器械的末端而不是尖头工作端。叩诊要注意以下三点：第一、选择对照，叩诊应从健康牙开始，逐渐过渡到可疑牙，即先叩正常牙，后叩患病牙齿。第二、叩击方向，垂直叩诊是叩击方向与牙长轴一致，主要是检查根尖部（E错）有无炎症。水平叩诊是叩击方向与牙长轴垂直，主要是根周部（D错）有无炎症。第三、力度适中，以健康的同名牙或邻牙叩诊不痛的最大力度为上限，力量先轻后重而不是从大到小（C错），对于急性尖周炎的患牙叩诊力度更要小，以免增加患者的痛苦。